女，52岁。半年前发现右乳腺肿物，发现时大小约2cmx1.5cm，无疼痛，质硬，活动度小。近来肿块扩展至乳房大部，整个乳房增大、红肿、充血、水肿、发热、质硬。此患者最可能的诊断是
A. 乳腺炎
B. 乳腺结核
C. 乳腺叶状肿瘤
D. 乳腺癌
E. 乳腺增生

正确答案：D。乳腺癌